恶性程度最高的甲状腺癌是
A. 乳头状癌
B. 滤泡癌
C. 髓样癌
D. 未分化癌
E. 导管癌

正确答案：D。未分化癌

解析：甲状腺癌的主要组织学类型有乳头状癌（A）、滤泡癌（B）、髓样癌（C）和未分化癌（D），其中恶性程度最高的是未分化癌（D对）。导管癌（E错）是乳腺癌（P303）的主要组织学类型。